女，30岁，开口受限1年，既往有关节弹响史。临床检查见开口度1指半，开口型左偏。首先应进行许勒位及经咽侧位检查，关节结构为T形致密团块代替，不是颞下颌关节紊乱综合征的表现。平片及体层摄影检查发现颞下颌关节前间隙增宽，髁状突骨质未见异常，应进一步进行下列哪项检查
A. 许勒位开口位
B. 颞下颌关节侧位体层
C. 颞下颌关节正位体层
D. 颞下颌关节CT检查
E. 颞下颌关节造影

正确答案：E。颞下颌关节造影

解析：本题考查颞下颌关节造影的适应证。颞下颌关节造影（E对）检查的适应证主要为观察关节盘的位置和是否存在关节盘穿孔，可显示关节盘移位，关节内各附着松弛或撕脱等。对于颞下颌关节前间隙增宽等改变，颞下颌关节造影均可作出较准确的诊断，因此临床上较为常用。许勒位开口位（A错）片可用来显示颞下颌关节外侧1/3侧斜位影像。颞下颌关节侧位体层（B错）片可用来显示经关节窝中部的关节侧位体层影像。颞下颌关节正位体层《口腔颌面医学影像诊断学（第七版）》未明确说明。颞下颌关节CT检查（D错）可清晰显示双侧髁突、关节结节、关节后结节横截面及关节前后间隙，但因为关节造影即可清晰显示关节间隙等诸改变，所以临床上常选择颞下颌关节造影。